男，68岁。阵发性腹痛1年，自觉有“气块”在腹中窜动，起初大便次数增加，近3个月腹胀便秘，近3天无肛门排气、排便，呕吐物有粪便臭味，一直感乏力和低热。禁忌使用的检查是
A. 腹部B超
B. 全消化道钡餐造影
C. 腹部X线平片
D. 结肠镜
E. 腹部CT

正确答案：B。全消化道钡餐造影

解析：患者腹痛、腹泻、肛门停止排气排便、呕吐物有粪便臭味（肠梗阻典型症状），肠梗阻病人严禁使用全消化道钡餐造影，否则可能造成钡剂堵塞肠管，加重病情（B错，为本题正确答案）。腹部B超（A对）、腹部X线平片（C对）、腹部CT（E对）禁忌极少，可作为辅助诊断措施。结肠镜（D对）可直视肠道病变，且患者无禁忌，对疾病诊断帮助很大。